奥美拉唑的作用机制为
A. 抑制组织胺和H2受体
B. 阻断H1受体
C. 保护胃黏膜
D. 促进胃酸分泌
E. 抑制H+-K+-ATP酶

正确答案：E。抑制H+-K+-ATP酶

解析：奥美拉唑的作用机制为抑制H+-K+-ATP酶（E对）。抑制组织胺和H2受体一般见于西咪替丁、雷尼替丁等（A错）。阻断H1受体的药物如六烃季铵、美加明等（B错）。保护胃黏膜（C错）药物的如米索前列醇。